硫黄的主要化学成分是
A. Na₂SO₄·10H₂O
B. S
C. As₂O₃
D. Fe₂O₃
E. HgS

正确答案：B。S

解析：本题考查的是硫黄的来源。硫黄的主要化学成分是S（B对）。硫黄：【来源】为自然元素类矿物硫族自然硫；或用含硫矿物经加工制得。主含硫（S）。Na₂SO₄·10H₂O（A错）为芒硝的主要化学成分。芒硝：【来源】为硫酸盐类矿物芒硝族芒硝，经加工精制而成的结晶体。主含含水硫酸钠（Na₂SO₄·10H₂O）。Fe₂O₃（D错）为赭石的主要化学成分。赭石：【来源】为氧化物类矿物刚玉族赤铁矿。主含三氧化二铁（Fe₂O₃）。HgS（E错）为朱砂的主要化学成分。朱砂：【来源】为硫化物类矿物辰砂族辰砂。主含硫化汞（HgS）。主要化学成分为As₂O₃（C错）的中药，2022年考试指南未明确说明。